WHO预防控制肺炎和腹泻的全球行动计划的目标之一
A. 到2025年三岁以下儿童腹泻导致的死亡率降到1‰以下
B. 前六个月纯母乳喂养婴儿
C. “三管一灭”
D. 设立腹泻病门诊
E. 轮状病毒疫苗接种

正确答案：A。到2025年三岁以下儿童腹泻导致的死亡率降到1‰以下

解析：本题考查WHO预防控制肺炎和腹泻的全球行动计划的目标。WHO预防控制肺炎和腹泻的全球行动计划中关于腹泻的目标是：到2025年三岁以下儿童腹泻导致的死亡率降到1‰以下（A对BCDE错）；相比2010年，减少75%的严重腹泻的发病。